女，35岁，因左下后牙对冷热刺激敏感1周前来就诊。检查发现左下第一磨牙（牙合）面深龋洞，探诊洞底感酸痛，冷测反应一过性敏感，叩痛（-）。牙龈无异常。该患牙的诊断是
A. 深龋
B. 可复性牙髓炎
C. 急性牙髓炎
D. 慢性牙髓炎
E. 牙髓钙化

正确答案：B。可复性牙髓炎

解析：本题考查可复性牙髓炎的临床表现。可复性牙髓炎的明显特点是对冷测反应一过性敏感，根据病例描述，左下后牙冷热刺激敏感1周，（牙合）面深龋洞，探诊洞底感酸痛，冷测反应一过性敏感，叩痛（-），可诊断为可复性牙髓炎（B对）。深龋（A错）往往是当冷、热刺激进入深龋洞内才出现疼痛反应，不会在冷测时出现一过性敏感。急性牙髓炎（C错）有自发痛，且温度刺激引起的反应程度较重，持续时间较长久，对冷测反应不会是一过性敏感。慢性牙髓炎（D错）往往有很长时间的冷、热刺激痛病史，炎症波及全部牙髓或根尖周牙周膜时可有咬合不适，轻度叩痛，且不会出现冷测时出现的一过性敏感。牙髓钙化（E错）一般无临床症状，个别情况出现与体位有关的自发痛，一般与温度刺激无关。